小儿咳嗽的致病原因主要为
A. 感受外邪
B. 素有伏痰
C. 饮食不当
D. 先天不足
E. 感受疫毒

正确答案：A。感受外邪

解析：小儿咳嗽的发生责之于外因和内因两个方面。外因主要是感受外邪，其中又以感受风邪为主；内因主要责之于肺脾虚弱。外邪从口鼻或皮毛而入，侵袭于肺，肺气不宣，清肃失职，而发生咳嗽；若小儿肺脾虚弱，脾虚生痰，上贮于肺，或久咳不愈，耗伤肺气，肺失宣降，导致咳嗽，故小儿咳嗽的致病原因主要为感受外邪（A对）。素有伏痰（B错）为哮喘的病因。饮食不当（C错）多引起脾系疾病。先天不足（D错）可引起肾系疾病或遗传代谢病。感受疫毒（E错）多引起急性感染性疾病。